下列涎腺肿瘤最易侵犯神经的是
A. 黏液表皮样癌
B. 腺泡细胞癌
C. 腺样囊性癌
D. 腺癌
E. 导管癌

正确答案：C。腺样囊性癌

解析：腺样囊性癌的临床病理特点：①肿瘤易沿神经扩散。②肿瘤浸润性极强。③肿瘤易侵入血管，造成血行性转移，转移率高达40%，为口腔颌面部恶性肿瘤中血液循环转移率较高的肿瘤之一；转移部位以肺为最多见。④颈淋巴结转移率很低，一般不必作选择性颈淋巴清除术；但位于舌根部的腺样囊性癌淋巴结转移率较高，可以考虑行选择性颈淋巴清扫术。⑤肿瘤细胞沿着骨髓腔浸润。⑥单纯放疗不能达到根治。⑦腺样囊性癌除实性型以外，一般生长缓慢，肺部转移灶也进展缓慢，患者可以长期带瘤生存。因此，即使出现肺转移，如果原发灶可以得到根治，仍可考虑行原发灶的手术治疗。掌握“腺样囊性癌”知识点。